关于牙周膜血管分布的特点，以下的说法错误的是
A. 牙周膜血管丰富，主要来自于牙槽动脉的血管
B. 牙颈部牙周膜血管与邻近的牙龈血管相互交联形成血管网
C. 因为牙周膜血管丰富，所以根尖切除手术中会影响牙周膜血供
D. 后牙的牙周膜血管比前牙的牙周膜血管丰富
E. 单个牙中近牙龈处的牙周膜血管比根尖区更丰富

正确答案：C。因为牙周膜血管丰富，所以根尖切除手术中会影响牙周膜血供

解析：牙周膜含有丰富的血管，为来自牙槽动脉的分支。牙颈区牙周膜血管分支与邻近的牙龈血管分支吻合形成血管网，故在根尖切除或牙龈切除时不会影响牙周膜的血液供给。牙周膜血管的分布因牙而异，后牙的牙周膜血管比前牙丰富，在单个牙中近牙龈处的牙周膜血管比根尖区更丰富。掌握“牙周膜”知识点。